根据药品管理法律法规及相关文件的规定，药品零售企业可以开架自选销售的药品是
A. 复方甘草片
B. 复方金银花颗粒
C. 复方地芬诺酯片
D. 复方枇杷喷托维林颗粒

正确答案：B。复方金银花颗粒

解析：本题考查含特殊药品复方制剂的零售管理。根据药品管理法律法规及相关文件的规定，药品零售企业可以开架自选销售的药品是复方金银花颗粒（B对）。复方金银花颗粒为甲类非处方药。复方枇杷喷托维林颗粒（D错）为处方药，药品零售企业不得采用开架自选的方式销售处方药。药品零售企业销售含特殊药品复方制剂时，处方药应当严格执行处方药与非处方药分类管理有关规定，复方甘草片（A错）、复方地芬诺酯片（C错）列入必须凭处方销售的处方药管理，严格凭医师开具的处方销售；除处方药外，非处方药一次销售不得超过5个最小包装（含麻黄碱复方制剂另有规定除外）。